“注意缺陷多动障碍”和“学习障碍”的患儿在以下哪个方面存在有区别
A. 多动
B. 智力低下
C. 学习困难
D. 不良情绪
E. 无明显区别

正确答案：D。不良情绪